在体内被单胺氧化酶和儿茶酚-O-甲基转移酶代谢失活，而口服无效，必须采用注射给药物有
A. 沙美特罗
B. 盐酸多巴酚丁胺
C. 盐酸异丙肾上腺素
D. 重酒石酸肾上腺素
E. 重酒石酸间羟胺

正确答案：B、C、D。盐酸多巴酚丁胺；盐酸异丙肾上腺素；重酒石酸肾上腺素

解析：本题考查儿茶酚胺类药物。儿茶酚胺类的代谢失活主要受到儿茶酚-O-甲基转移酶（COMT）和单胺氧化酶（MAO）的催化，分别发生苯环3-羟基的甲基化和侧链末端氨基的氧化脱除。口服无效，需注射给药的药物包括：盐酸多巴胺、盐酸多巴酚丁胺（B对）、盐酸异丙肾上腺素（C对）、重酒石酸肾上腺素（D对）等。